对核酸进行定量和纯度分析时常利用
A. 核酸分子在200nm波长处有最大紫外吸收
B. 核酸分子在220nm波长处有最大紫外吸收
C. 核酸分子在240nm波长处有最大紫外吸收
D. 核酸分子在260nm波长处有最大紫外吸收
E. 核酸分子在280nm波长处有最大紫外吸收

正确答案：D。核酸分子在260nm波长处有最大紫外吸收

解析：核酸分子的碱基含有共轭双键，在260nm波长处有最大紫外吸收，可以利用这一特性对核酸进行定量和纯度分析。掌握“核苷酸”知识点。